Ⅲ度松动牙的松动幅度是
A. 不超过1mm
B. 1～1.5mm
C. 1.5～2mm
D. 大于2mm
E. 以上均不对

正确答案：D。大于2mm

解析：以牙松动幅度计算：Ⅰ度松动：松动幅度不超过1mm。Ⅱ度松动：松动幅度为1～2mm。Ⅲ度松动：松动幅度大于2mm。掌握“修复学临床检查”知识点。